有关生理因素影响口服给药吸收的叙述，不正确的是
A. 药物的吸收与胃肠液的pH有关，胃液的pH约1.0时，有利于弱酸性药物的吸收
B. 药物的吸收与胃肠液的pH有关，小肠部位肠液的pH通常为5～7，有利于弱碱性药物的吸收
C. 胃肠液中的胆盐能增加所有药物的吸收
D. 胃排空速率快，有利于药物吸收
E. 消化道上皮细胞部位的血液循环状况影响药物吸收

正确答案：C。胃肠液中的胆盐能增加所有药物的吸收